青霉素过敏性试验的给药途径是
A. 皮内注射
B. 皮下注射
C. 肌内注射
D. 静脉注射
E. 静脉滴注

正确答案：A。皮内注射

解析：本题考查注射给药的给药部位和吸收途径。青霉素过敏性试验的给药途径是皮内注射（A对）；皮下注射（B错）：皮下组织血管较少及血流速度慢，需延长作用时间的药物可采用皮下注射；肌内注射（C错）吸收速度快于皮下注射；静脉注射（D错）、静脉滴注（E错）中药液均直接进入血液。